关于舌淋巴引流特点，叙述正确的是
A. 舌的淋巴引流丰富，最终汇入颈深下淋巴结
B. 近舌尖起的淋巴管，注入颈深上淋巴结的部位愈高
C. 近舌根起的淋巴管，注入颈深上淋巴结的部位愈高
D. 近舌根起的淋巴管，注入颈深上淋巴结的部位愈低
E. 以上叙述均不正确

正确答案：C。近舌根起的淋巴管，注入颈深上淋巴结的部位愈高

解析：舌的淋巴极为丰富，主要起于粘膜下及肌层，淋巴管最终汇入颈深上淋巴结。舌的淋巴管与颈深上淋巴结的引流关系规律为：愈近舌尖而起的淋巴管，其注入的颈深上淋巴结所在的部位愈低；愈近舌根部而起的淋巴管，其注入的颈深上淋巴结所在部位愈高。掌握“腭、舌、舌下区的局部解剖”知识点。